腋窝Ⅱ组淋巴结位于
A. 胸大肌外侧
B. 胸小肌外侧
C. 胸大、小肌间
D. 胸大肌内侧
E. 胸小肌内侧

正确答案：C。胸大、小肌间

解析：目前，通常以胸小肌为标志将腋区淋巴结分为三组：Ⅰ组：胸小肌外侧（B错）腋窝淋巴结；Ⅱ组：胸小肌后方的腋静脉淋巴结和胸大、小肌间的淋巴结（Rotter淋巴结）（C对）；Ⅲ组：胸小肌内侧（E错）锁骨下淋巴结。